男，65岁。2周前拔除上颌剩余牙，要求全口义齿修复。检查：上颌牙槽嵴丰满，26和27拔牙窝未完全愈合，拔牙窝颊侧边缘可见明显骨尖，下颌为完整天然牙列，叩痛（-），不松动，牙周状况良好，下颌spee’s曲线曲度大，前部颌间距离约2mm，颌位关系正常。调整下颌spee’s曲线的措施为
A. 下颌牙连冠修复
B. 降低下前牙高度
C. 下后牙冠修复
D. 降低下后牙高度
E. 下颌全口连冠修复

正确答案：B。降低下前牙高度

解析：本题考查单颌全口义齿的修复方法。男，65岁。2周前拔除上颌剩余牙，要求全口义齿修复。检查：上颌牙槽嵴丰满，26和27拔牙窝未完全愈合，拔牙窝颊侧边缘可见明显骨尖，下颌为完整天然牙列，叩痛（-），不松动，牙周状况良好，下颌spee’s曲线曲度大，前部颌间距离约2mm，颌位关系正常。调整下颌spee’s曲线的措施为降低下前牙高度（B对）。上颌牙全部缺失，下颌牙是完整天然牙列，全口义齿修复时应尽量恢复正常牙合平面和牙合曲线。下前牙过长、前部颌间距离过短时，应调磨下前牙唇斜面，降低牙冠高度；后牙形成反横牙合曲线时，降低下后牙舌尖的高度（D错）；牙合平面倾斜或高低不平时，低位牙可选择高嵌体、全冠或牙合垫修复（ACE错）。